男，31岁。车祸致枕部着地昏迷1小时。查体：P60次/分，R12次/分，BP170/90mmhg。右侧顶枕部头皮血肿，GSC评分7分，右侧瞳孔2mm，对痛觉刺激无反应。左侧瞳孔4mm，瞳孔对光反射消失。患者左侧额颞底部弥漫挫裂伤，血肿体积约60ml，致同侧脑室受压，中线向右移位15mm。最适宜采取的治疗措施为
A. 绝对卧床休息
B. 腰椎穿刺排放脑脊液
C. 大剂量糖皮质激素
D. 脑室外引流
E. 急诊开颅手术

正确答案：E。急诊开颅手术

解析：车祸致枕部着地，瞳孔左：右=4mm：2mm（瞳孔正常直径为3-4mm，双侧瞳孔大小不等），左侧对光反射消失（双侧瞳孔不等且伴有对光反射减弱或消失以及神志不清，往往是中脑功能损害的表现），右侧肢体偏瘫（脑损伤的表现），昏迷，血压上升、脉搏变慢、呼吸深慢，GCS5分（重型脑外伤），因此诊断为重型脑损伤。患者出现偏瘫等的脑内损伤，最应该采取的治疗措施是急诊开颅手术（E对），清除血肿，防止颅内压升高。